患者，男，26岁。先天性心脏病致心力衰竭，应用强心苷疗效不显著。可试换用的药物是
A. 氯化钙
B. 阿托品
C. 卡托普利
D. 肾上腺素
E. 异丙肾上腺素

正确答案：C。卡托普利

解析：当先天性心脏病致心力衰竭应用强心苷疗效不显著时，可试换卡托普利（C对）。卡托普利为血紧张素转换酶抑制剂，通过抑制循环和组织的RAS及作用于激肽酶的降解，提高缓激肽水平，除了发挥扩血管作用改善心衰时的血流动力学、减轻淤血症状外，更重要的是可降低心衰患者代偿性神经-体液因素的不利影响，限制心肌、小血管的重塑，以达到维护心肌功能，推迟充血性心力衰竭的进展，降低远期死亡率的目的（ABDE错）。